患者，男，36岁，肥胖，2型糖尿病，肝肾功能正常，在饮食和运动管理基础上长期服用二甲双胍2g/d，血糖控制不理想。为控制血糖，且不增加患者体重可加用的降糖药物是
A. 格列喹酮
B. 瑞格列奈
C. 利拉鲁肽
D. 胰岛素
E. 罗格列酮

正确答案：C。利拉鲁肽

解析：本题考查降糖药。为控制血糖，且不增加患者体重可加用的降糖药物是利拉鲁肽（C对）。利拉鲁肽属于GLP-1受体激动剂，可用于单用二甲双胍后血糖控制仍不佳的患者，使体重减轻。磺酰脲类（A错）和格列奈类（B错）都可导致体重增加。该患者为2型糖尿病，肝肾功能正常，联合用药不选择胰岛素（D错）。TZDs类（罗格列酮）（E错）常见不良反应为体重增加和水肿。